26岁初产妇，妊娠39周，规律宫缩8小时。血压110/70mmHg，骨盆不小，预测胎儿体重为2700g，枕左前位，胎心率正常。肛查宫口开大3cm，S=0。正确处置应是
A. 不需干涉产程进展
B. 静脉推注地西泮10mg
C. 静脉缓注25%硫酸镁16ml
D. 静脉滴注缩宫素
E. 行人工破膜

正确答案：A。不需干涉产程进展

解析：青年初产妇，妊娠39周，规律宫缩8小时（未超过8小时），血压正常，骨盆盆不小，预测胎儿体重为2700g（正常出生体重为2500g～4000g），枕左前位（胎位正常），胎心率正常，肛查宫口开大3cm，S=0（说明胎儿胎头已衔接入盆），该孕妇处于正常产程，故不需干涉产程进展（A对）。人工破膜（P189）（B错）适用于宫口扩张≥3cm、无头盆不称、胎头已衔接而产程延缓者。静脉缓注25％硫酸镁（P71）（C错）主要用于治疗子痫。静脉滴注缩宫素（P189）（D错）适用于协调性宫缩乏力、宫口扩张≥3cm、胎心良好、胎位正常、头盆相称者。静脉推注地西泮（P189）（B错）主要用于宫口扩张缓慢合并宫颈水肿者。